粉葛的性状特征有
A. 呈圆柱形、纺锤形或半圆柱形
B. 表面黄白色或淡棕色，未去外皮的灰棕色
C. 横切面可见由纤维和导管形成的浅棕色同心环纹
D. 体重，质硬，富粉性
E. 气清香，味微甜、涩

正确答案：A、B、C、D。呈圆柱形、纺锤形或半圆柱形；表面黄白色或淡棕色，未去外皮的灰棕色；横切面可见由纤维和导管形成的浅棕色同心环纹；体重，质硬，富粉性